经肝脏D-25羟化酶代谢直接生成骨化三醇的药物是
A. 维生素D₂
B. 麦角骨化醇
C. 阿法骨化醇
D. 胆骨化醇
E. 维生素D₃

正确答案：C。阿法骨化醇

解析：本题考查促进钙吸收药物。阿法骨化醇（C对）经肝脏D-25羟化酶代谢直接生成骨化三醇。维生素D₂（也称麦角骨化醇）（AB错）和维生素D₃（胆骨化醇）（DE错）本身无活性，须在肝脏和肾脏两次羟基化，代谢为骨化三醇起作用。